肿瘤相关抗原通常不能诱导有效抗肿瘤免疫的原因是
A. 无诱导抗体产生能力
B. 表达量低
C. 多为自身抗原
D. 抗原具有单一性
E. 多为TI抗原

正确答案：A。无诱导抗体产生能力

解析：肿瘤相关抗原指肿瘤细胞和正常细胞组织均可表达的抗原，其含量在细胞癌变时明显增高（B错），即此类抗原只表现出量的变化而无严格的肿瘤特异性，故免疫性弱，无法诱发机体产生足够强度的抗肿瘤免疫应答清除细胞，即不能诱导有效抗肿瘤免疫（A对）。